子宫内膜异位症的好发部位是
A. 子宫内膜
B. 子宫阔韧带
C. 子官圆韧带
D. 卵巢
E. 阴道

正确答案：D。卵巢

解析：子宫内膜异位症是指子宫内膜组织出现在子宫体以外的部位。异位的内膜可侵犯全身任何部位，但绝大多数位于盆腔脏器和壁腹膜，其最好发部位是卵巢（D对）和宫骶韧带，其次为子宫及其他脏腹膜、阴道直肠膈等部位。